根据现行GSP的规定，药品批发企业从事质量管理工作的人员应具有
A. 药学或相关专业的学历，或者具有药学专业的技术职称
B. 药学专业技术职称
C. 相应的药学专业技术职称
D. 药师以上专业技术职称
E. 主管药师以上专业技术职称

正确答案：A。药学或相关专业的学历，或者具有药学专业的技术职称

解析：本题考查药品批发企业经营和质量管理人员的资质要求。根据现行GSP的规定药品批发企业从事质量管理工作的人员应具有药学中专或者医学、生物、化学等相关专业大学专科以上学历或者具有药学初级以上专业技术职称（A对）。